Kennedy第一类缺失的设计一般为
A. 牙支持式义齿和黏膜支持式义齿
B. 混合支持式义齿和牙支持式义齿
C. 混合支持式义齿和黏膜支持式义齿
D. 混合支持式义齿
E. 黏膜支持式义齿

正确答案：C。混合支持式义齿和黏膜支持式义齿

解析：本题考查局部义齿的设计。Kennedy第一类缺失设计要点：根据临床缺失情况，Kennedy第一类缺失有两种设计，一为混合支持式义齿，一为黏膜支持式义齿（C对）。Kennedy第一类为双侧远中游离端缺失，因此在设计上要根据基牙的情况选择具体的设计方案，常用的为混合支持式或黏膜支持式。